患者，男，35岁，左下肢皮肤溃烂，向周围浸淫，剧痛，局部红肿，伴口干口渴，大便秘结，小便短赤，舌红，苔黄腻，脉弦数。该患者诊断为
A. 脱疽，寒湿阻络证
B. 脱疽，热毒伤阴证
C. 脱疽，气阴两虚证
D. 脱疽，湿盛热毒证
E. 脱疽，血脉瘀阻证

正确答案：D。脱疽，湿盛热毒证

解析：患者左下肢皮肤溃烂，向周围浸淫，剧痛，可诊断为脱疽。患者溃烂局部红肿，剧痛，向周围浸淫，伴口干口渴，大便秘结，小便短赤，可辨证为湿热毒盛证；舌红，苔黄腻，脉弦数为湿热毒盛证的表现（D对）。寒湿阻络证主要表现为患趾（指）喜暖怕冷，麻木，酸胀疼痛，多走疼痛加剧，稍歇痛减，皮肤苍白，触之发凉，趺阳脉搏动减弱；舌淡，苔白腻，脉沉细（A错）。血脉瘀阻证主要表现为患趾（指）酸胀疼痛加重，夜难人寐，步履艰难，患趾（指）皮色暗红或紫暗，下垂更甚，皮肤发凉干燥，肌肉萎缩，趺阳脉搏动消失；舌暗红或有瘀斑，苔薄白，脉弦涩（E错）。热毒伤阴证主要表现为皮肤干燥，毫毛脱落，趾（指）甲增厚变形，肌肉萎缩，趾（指）呈干性坏疽；口干欲饮，便秘溲赤；舌红，苔黄，脉弦细数（B错）。气阴两虚证主要表现为病程日久，坏死组织脱落后疮面久不愈合，肉芽暗红或淡而不鲜；倦怠乏力，不欲饮食，面色少华，形体消瘦；舌淡，少苔，脉细无力（C错）。